下列属于方书典籍的有
A. 《肘后备急方》
B. 《千金要方》
C. 《千金翼方》
D. 《外台秘要》
E. 《雷公炮炙论》

正确答案：A、B、C、D。《肘后备急方》；《千金要方》；《千金翼方》；《外台秘要》

解析：本题考查主要方书典籍。主要方书典籍：1.《肘后备急方》（A对）2.《备急千金要方》（B对）3.《千金翼方》（C对）4.《外台秘要》（E对）5.《太平圣惠方》6.《太平惠民和剂局方》7.《普济方》。《雷公炮炙论》（D错）属于主要炮炙典籍。